危险度特征分析时，对有阈化学物可计算出
A. 人群终生超额危险度
B. 人群年超额危险度
C. 人群年超额病例数
D. B＋C
E. A＋B＋C

正确答案：E。A＋B＋C

解析：本题考查危险度特征分析的相关内容。危险度特征分析时，对有阈化学物可计算出：①人群终生超额危险度；②人群年超额危险度；③人群年超额病例数（E对ABCD错）。